与水共研能形成黄棕色乳状液的药材是
A. 乳香
B. 没药
C. 血竭
D. 青黛
E. 冰片

正确答案：B。没药

解析：本题考查没药的理化鉴别。与水共研能形成黄棕色乳状液的药材是没药（B对）。没药【理化鉴别】取本品与水共研形成黄棕色乳状液。粉末遇硝酸呈紫色。乳香（A错）【理化鉴别】本品遇热变软，烧之微有香气（不应有松香气），显油性，冒黑烟，与少量水共研，能形成白色或黄白色乳状液。血竭（C错）【理化鉴别】取本品粉末置白纸上，用火隔纸烘烤即熔化，应无扩散的油迹，对光照视呈鲜艳的血红色。以火燃烧则产生呛鼻烟气。青黛（D错）【理化鉴别】取本品少量，用微火灼烧，有紫红色烟雾产生。冰片（E错）【理化鉴别】点燃可发生浓烟，并有带光的火焰。